下列关于甲型肝炎的人群易感性说法正确的是
A. 1岁以内的婴幼儿对HAV易感性高
B. 人群对HAV普遍易感
C. HAV人群易感性随年龄的增加而增加
D. 感染HAV后的人群可获得短暂免疫力
E. 婴幼儿期甲型肝炎的易感性最低

正确答案：B。人群对HAV普遍易感